某女，75岁。形体较瘦，头晕耳鸣，眼目干涩，口燥咽干，潮热颧红，五心频热，盗汗，小便短黄，大便干结；舌红，无苔，脉细数。可选用的中成药有
A. 左归丸
B. 六味地黄丸
C. 杞菊地黄丸
D. 右归丸
E. 济生肾气丸

正确答案：A、B、C。左归丸；六味地黄丸；杞菊地黄丸

解析：本题考查虚劳之阴虚证的中成药应用。患者为虚劳之阴虚证，可选用的中成药有左归丸（A对）、六味地黄丸（B对）、杞菊地黄丸（C对）。虚劳之阴虚证【症状】形体消瘦，口燥咽干，潮热颧红，五心烦热，盗汗，小便短黄，大便干结。舌质红，舌面少津，苔少或无苔，脉细数。【中成药应用】常用中成药人参固本丸（大蜜丸）、河车大造丸、左归丸、六味地黄丸、杞菊地黄丸。阳痿之肾阳不足证【症状】阳事不举，或举而不坚，精薄清冷；伴神疲倦怠，形寒肢冷，阴部冷凉，面色无华，头晕耳鸣，腰膝酸软，小便清长。舌淡胖，苔薄白，脉沉细。【方剂应用】基础方剂右归丸（D错）。癃闭之肾阳衰惫证【症状】小便不通或点滴不爽，排出无力，面色㿠白，神气怯弱，畏寒肢冷，腰膝冷而酸软无力。舌淡胖，苔薄白，脉沉细或弱。【中成药应用】常用中成药济生肾气丸（E错）、金匮肾气丸。